下列不是年轻恒牙牙髓病的特点
A. 年轻恒牙牙髓炎多由龋病引起
B. 龋病引起的牙髓炎症以慢性炎症为主
C. 牙髓广泛暴露可形成慢性增生性牙髓炎
D. 急性牙髓炎往往是慢性牙髓炎急性发作
E. 根尖周组织致密，炎症感染不易扩散

正确答案：E。根尖周组织致密，炎症感染不易扩散

解析：年轻恒牙的牙髓病特点：①年轻恒牙牙髓炎多由龋病引起。牙齿结构异常、外伤、创伤、医源性因素也可引起。②龋病引起的牙髓炎症以慢性炎症为主，如果牙髓暴露广泛，可形成慢性增生性牙髓炎，即形成牙髓息肉。急性牙髓炎往往是慢性牙髓炎急性发作。严重的牙齿外伤或制备洞形过程中意外露髓可使牙髓发生急性炎症，或牙髓坏死。③由于年轻恒牙牙髓组织和根尖周组织疏松，血运丰富，炎症感染易于扩散，如治疗及时，炎症也易控制和恢复。掌握“年轻恒牙牙髓病及根尖周病诊断及治疗”知识点。